下列属于吗啡药理作用的是
A. 选择性镇痛作用
B. 消除由疼痛所引起的焦虑、紧张、恐惧等情绪反应
C. 提高对疼痛的耐受力
D. 有助于患者入睡
E. 使呼吸频率减慢

正确答案：A、B、C、D、E。选择性镇痛作用；消除由疼痛所引起的焦虑、紧张、恐惧等情绪反应；提高对疼痛的耐受力；有助于患者入睡；使呼吸频率减慢

解析：本题考查吗啡。吗啡属于阿片类镇痛药，有强镇痛作用（A对），能够提高对疼痛的耐受力（C对），消除疼痛所引起的焦虑、紧张、恐惧等情绪反应（B对）；激动μ₂受体可引起呼吸抑制，使呼吸频率减慢（E对）；激动к受体可引起脊髓水平镇痛、镇静和轻度呼吸抑制，有助于患者入睡（D对）。